药品广告不得“妨碍环境和自然资源保护”出自于
A. 《中华人民共和国广告法》
B. 《中华人民共和国药品管理法》
C. 《中华人民共和国药品管理法实施条例》
D. 《药品经营质量管理规范》
E. 《处方药与非处方药分类管理办法（试行）》

正确答案：A。《中华人民共和国广告法》

解析：本题考查《中华人民共和国广告法》。药品广告不得“妨碍环境和自然资源保护”出自于《中华人民共和国广告法》（A对）。《中华人民共和国广告法》第二章广告内容准则第九条：广告不得有下列情形：（一）使用或者变相使用中华人民共和国的国旗、国歌、国徽，军旗、军歌、军徽；（二）使用或者变相使用国家机关、国家机关工作人员的名义或者形象；（三）使用“国家级”“最高级”“最佳”等用语；（四）损害国家的尊严或者利益，泄露国家秘密；（五）妨碍社会安定，损害社会公共利益；（六）危害人身、财产安全，泄露个人隐私；（七）妨碍社会公共秩序或者违背社会良好风尚；（八）含有淫秽、色情、赌博、迷信、恐怖、暴力的内容；（九）含有民族、种族、宗教、性别歧视的内容；（十）妨碍环境、自然资源或者文化遗产保护；（十一）法律、行政法规规定禁止的其他情形。